既平肝潜阳，又清肝明目的药是
A. 珍珠
B. 蒺藜
C. 僵蚕
D. 珍珠母
E. 罗布麻叶

正确答案：D。珍珠母

解析：本题考查的是珍珠母的功效。既平肝潜阳，又清肝明目的药是珍珠母（D对）。珍珠母：【功效】平肝潜阳，清肝明目，安神定惊，收湿敛疮。珍珠（A错）：【功效】安神定惊，明目除翳，解毒敛疮，润肤祛斑。蒺藜（B错）：【功效】平肝，疏肝，祛风明目，散风止痒。僵蚕（C错）：【功效】息风止痉，祛风止痛，化痰散结。罗布麻叶（E错）：【功效】平肝清热，降血压，利水。